治疗肺痈咳唾浊痰，黄绿而味腥者，应首选
A. 清金化痰汤
B. 千金苇茎汤
C. 加减泻白散
D. 定喘汤
E. 加味桔梗汤

正确答案：B。千金苇茎汤

解析：患者咳唾浊痰，故诊断为肺痈。痰浊瘀热郁蒸成痈，则痰黄绿而味腥，故诊断为成痈期。治以清肺解毒，化瘀消痈，代表方为千金苇茎汤合如金解毒散加减，根据最佳选项原则，选择千金苇茎汤化痰泄热，通瘀散结消痈（B对）。清金化痰汤，其功用为清热化痰，可用于内伤咳嗽之痰热郁肺证（A错）。加减泻白散，与黛蛤散合用用于咳嗽之肝火犯肺证（C错）。定喘汤，其功用为宣肺降气，清热化痰，可用于热哮证（D错）。加味桔梗汤，其功用为清肺化痰，排脓泄壅，可用于肺痈之溃脓期（E错）。